超声波洁牙机的使用方法，不正确的是
A. 放稳支点
B. 握笔式握持器械需稳而轻
C. 将工作头放在牙面上，紧密接触，以利于去除牙石
D. 工作头与牙面平行或15°角
E. 以工作头的前端部分接触牙石的下方来回移动

正确答案：C。将工作头放在牙面上，紧密接触，以利于去除牙石

解析：超声洁牙机的工作端要与牙石相接处，不能直接接触牙面，会在釉质表面造成划痕。超声波洁治时以握笔式将工作头的前端部分轻轻以与牙面平行或＜15°角接触牙石的下方来回移动，利用超声振动击碎并振落牙石是正确的。80°的是对手动龈下刮治器而言的。掌握“慢性牙周炎的治疗原则、程序及方法”知识点。